患者，男，58岁。高血压病史20年，近1年常觉心慌，气短。昨夜睡眠中突然憋醒，胸闷，咳嗽，气喘，急诊入院。经检查诊断为急性肺水肿，左心衰竭。治疗宜用
A. 肾上腺素
B. 异丙肾上腺素
C. 东莨菪碱
D. 吗啡
E. 以上均非

正确答案：D。吗啡

解析：患者有高血压病史，又突发急性肺水肿、左心衰竭。吗啡（D对）有舒张心肌的作用，防止呼吸肌痉挛出现呼吸衰竭。肾上腺素（A错）及异丙肾上腺素（B错）均具有升压作用，故高血压患者慎用。东莨菪碱（C错）对呼吸中枢的兴奋作用明显，但对左心衰竭无治疗作用。